贮存中不宜冷冻的药品有
A. 精蛋白锌胰岛素注射液
B. 注射用人纤维蛋白质
C. 前列地尔注射液
D. 卡前列甲酯栓
E. 脂肪乳

正确答案：A、B、C、E。精蛋白锌胰岛素注射液；注射用人纤维蛋白质；前列地尔注射液；脂肪乳

解析：本题考查药品的贮存。精蛋白锌胰岛素注射液（A对）、注射用人纤维蛋白质（B对）、前列地尔注射液（C对）、脂肪乳（E对）冷冻会变质，不宜冷冻。卡前列甲酯栓（D错）应遮光，密闭，低温（低于-5℃）保存。